服用异烟肼进行抗结核治疗的患者，为预防周围神经炎，应补充的维生素是
A. 维生素B₆
B. 维生素C
C. 维生素A
D. 维生素B₂
E. 维生素K

正确答案：A。维生素B₆

解析：本题考查维生素B₆。服用异烟肼进行抗结核治疗的患者，为预防周围神经炎，应补充的维生素是维生素B₆（A对）。异烟肼为维生素B₆的拮抗剂，可增加维生素B₆经肾排出量，易致周围神经炎的发生（D对）。同时服用维生素B₆者，需酌情增加用量。